妊娠5个月后应用时，可使婴儿牙齿黄染、釉质发育不全的是
A. 庆大霉素
B. 氯喹
C. 维生素D
D. 四环素
E. 甲硫咪唑

正确答案：D。四环素